关于左侧面神经核上瘫的描述，正确的是
A. 右侧面部表情肌全部瘫痪
B. 左侧面部表情肌全部瘫痪
C. 左侧额纹消失
D. 右侧额纹消失
E. 两侧额纹不消失

正确答案：E。两侧额纹不消失

解析：中枢性面瘫（核上瘫）会造成病灶对侧鼻唇沟消失，病灶对侧口角低垂口角歪向病灶侧，病灶对侧不能作露齿动作，而不是一侧面部表情肌全部瘫痪（AB错）。病灶对侧额纹消失为核下瘫的表现（DE错）。左侧面神经核上瘫两侧额纹不消失（E对）。